对诊断甲状腺破坏所致甲状腺毒症有重要意义的表现是
A. 甲状腺肿大
B. 血T3、T4↑，甲状腺摄¹³¹I率明显↓
C. 血T3、T4↑，甲状腺摄¹³¹I率明显↑
D. TgAb与TPOAb常明显↑
E. TSH明显↓

正确答案：B。血T3、T4↑，甲状腺摄¹³¹I率明显↓

解析：甲状腺毒症可分为甲状腺功能亢进类型和非甲状腺功能亢进类型。非甲状腺功能亢进类型包括破坏性甲状腺毒症和服用外源性甲状腺激素。甲状腺滤泡破坏时，其内储存的甲状腺激素释放进入循环，血T3、T4↑，形成“破坏性甲状腺毒症”；其甲状腺的功能并不亢进，反而因甲状腺破坏造成甲状腺摄¹³¹I率明显↓（B对）（P680）。